《麻醉药品和精神药品管理条例》规定，全国性批发企业
A. 应当从定点生产企业购进第一类精神药品
B. 可以向区域性批发企业销售第一类精神药品
C. 可以向区域性批发企业销售第二类精神药品
D. 可以向药品零售企业供应第一类精神药品
E. 不可以向医疗机构销售第一类精神药品

正确答案：A、B、C。应当从定点生产企业购进第一类精神药品；可以向区域性批发企业销售第一类精神药品；可以向区域性批发企业销售第二类精神药品

解析：本题考查麻醉药品和精神药品的购销管理。《麻醉药品和精神药品管理条例》规定，全国性批发企业应当从定点生产企业购进第一类精神药品（A对）、可以向区域性批发企业销售第一类精神药品（B对）、可以向区域性批发企业销售第二类精神药品（C对）。全国性批发企业，应当从定点生产企业购进麻醉药品和第一类精神药品。从事第二类精神药品批发业务的企业，可以从第二类精神药品定点生产企业、具有第二类精神药品经营资格的定点批发企业（全国性批发企业、区域性批发企业、其他专门从事第二类精神药品批发业务的企业）购进第二类精神药品。全国性批发企业在确保责任区内区域性批发企业供药的基础上，可以在全国范围内向其他区域性批发企业销售麻醉药品和第一类精神药品。全国性批发企业向取得麻醉药品和第一类精神药品使用资格的医疗机构销售麻醉药品和第一类精神药品，须经医疗机构所在地省（区、市）药品监督管理部门批准（E错）。从事第二类精神药品批发业务的企业，可以将第二类精神药品销售给定点生产企业、具有第二类精神药品经营资格的药品批发企业、医疗机构、从事第二类精神药品零售的药品零售连锁企业（D错）。